氧需超过氧上限的是
A. 打字
B. 搬运重物、爬坡
C. 100米跑
D. 动态作业
E. 静态作业

正确答案：B。搬运重物、爬坡